血液中非结合胆红素明显升高见于
A. 溶血性黄疸
B. 肝细胞性黄疸
C. 胆汁淤积性黄疸
D. Dubin-Johnson综合征
E. 以上都不是

正确答案：A。溶血性黄疸

解析：溶血性黄疸（A对E错）是指由于大量红细胞被破坏，形成大量的非结合胆红素，超过肝细胞的摄取、结合与排泌能力所致的疾病。另一方面，由于溶血造成的贫血、缺氧和红细胞破坏产物的毒性作用，削弱了肝细胞对胆红素的代谢功能，使非结合胆红素在血中潴留，血清总胆红素第十版药理学（TB）增加，以非结合胆红素（UCB）为主（C错），结合胆红素第（CB）基本正常。由于血中UCB增加，故CB形成也代偿性增加，从胆道排至肠道也增加，致尿胆原增加，粪胆原随之增加，便色加深。肠内的尿胆原增加，重吸收至肝内者也增加。由于缺氧及毒素作用，肝脏处理增多尿胆原的能力降低，致血中尿胆原增加，并从肾排出，故尿中尿胆原增加，但尿中结合胆红素阴性，大便颜色变深。肝细胞性黄疸（B错）、胆汁淤积性黄疸（C错）、Dubin-Johnson综合征（D错）（又称为慢性特发性黄疸，为遗传性结合胆红素增高Ⅰ型）临床表现特点为长期性或间歇性黄疸，血液中结合胆红素和非结合胆红素均增加。